某病人要做腰穿检查，有恐惧感。从医德要求考虑，临床医生应向病人做的主要工作是
A. 要得到病人知情同意
B. 告知做腰穿的必要性，嘱病人配合
C. 告知做腰穿时应注意的事项
D. 因诊断需要，先动员，后检查
E. 动员家属做病人思想工作

正确答案：A。要得到病人知情同意

解析：知情同意是尊重患者自主性的具体体现，是指在临床过程中，医务人员为患者作出诊断和治疗方案后，应当向患者提供包括诊断结论、治疗决策、病情预后以及诊治费用等方面的真实、充分的信息，尤其是诊疗方案的性质、作用、依据、损伤、风险以及不可预测的意外等情况，使患者或其家属经过深思熟虑自主地作出选择，并以相应的方式表达其接受或者拒绝此种诊疗方案的意愿和承诺。掌握“医务人员之间关系伦理”知识点。